土壤污染的基本特点，不包括
A. 隐蔽性
B. 累积性
C. 不可逆转性
D. 长期性
E. 易迁移性

正确答案：E。易迁移性

解析：本题考查土壤污染的基本特点。土壤污染是指在人类生产和生活活动中排出的有害物质进入土壤中，超过一定限量，直接或间接地危害人畜健康的现象。其基本特点包括：1.隐蔽性（A对）：污染进入土壤时由于有害物质在土壤中可与土壤成分相结合，有的有害物质会被土壤生物分解或吸收，从而改变了其本来性质和特征。而且，当土壤将有害物质输送给农作物，再通过食物链而损害人畜健康时，土壤本身可能还会继续保持其生产能力；2.累积性（B对）：土壤对污染物进行吸附、固定、植物吸收。特别是重金属和放射性元素都能与土壤有机质或矿物质相结合，并且不断积累达到很高的浓度，长久地保存在土壤中，表现为很强的累积性、地域性特点，成为顽固的环境污染问题；3.不可逆转性（C对）：重金属对土壤环境的污染基本上是一个不可逆的过程。同样，许多有机化合物对土壤环境的污染也需要较长的时间才能降解，尤其是那些持久性有机污染物不仅在土壤环境中很难被降解，而且可能产生毒性较大的中间产物；4.长期性（D对）：土壤环境一旦被污染，仅仅依靠切断污染源的方法很难自我修复，如受某些重金属污染的土壤可能需要100～200年才能够恢复。只有采用有效的治理技术才能消除现实污染。易迁移性（E错，为本题正确答案）不属于土壤污染的基本特点。